对于有脑水肿、颅内压增高的患者脱水治疗时常选用
A. 10%甘露醇
B. 15%山梨醇
C. 20%甘露醇
D. 25%葡萄糖
E. 30%葡萄糖

正确答案：C。20%甘露醇

解析：对于有脑水肿、颅内压增高的患者应予脱水治疗，常用20%甘露醇快速静脉滴注，每次剂量250ml，每6～12小时1次；也可用25%山梨醇或50%葡萄糖等。掌握“口腔颌面部创伤急救”知识点。